营养不良属于
A. 疾病发生的原因
B. 疾病发生的条件
C. 两者均有
D. 两者均无
E. 无

正确答案：C。两者均有

解析：营养缺乏是营养不良症的致病因素，而营养缺乏使机体抵抗力降低，却又是某些疾病(如结核病)发生的重要条件之一（C对）。